下列哪个选项不是影响毒作用的因素
A. 剂量
B. 接触吸收速率
C. 接触途径
D. 接触面积

正确答案：D。接触面积

解析：本题考查影响毒作用的因素。毒作用是指在一定条件下，化学物导致机体发生的有害生物学改变。化学物质的毒作用总是与一定的剂量联系在一起的，影响毒作用大小的因素主要有剂量（A对）接触吸收速率（B对）、接触途径（C对）等。接触面积（D错，为本题正确答案）不是影响毒作用的因素。